以下描述属于普查优点的是
A. 调查的精确性高，不容易出现漏查
B. 适合患病率较低疾病的调查
C. 统一的调查技术可以有效保证调查质量
D. 可以很快获得疾病的发病率资料
E. 确定调查对象比较简单

正确答案：E。确定调查对象比较简单

解析：本题考查普查的优点。普查的优点有：①调查对象为全体目标人群（E对D错），不存在抽样误差；②可以同时调查目标人群中多种疾病或健康状况的分布情况；③能发现目标人群中的全部病例，在实现“三早”（早期发现、早期诊断、早期治疗）预防的同时，全面地描述疾病的分布与特征，为病因分析研究提供线索。普查的缺点有：①不适用于患病率低（B错）且无简便易行诊断手段的疾病；②工作量大，因此不易细致，难免存在漏查（A错）；③调查工作人员涉及面广，掌握调查技术和检查方法的熟练程度不一，对调查项目的理解往往很难统一和标准化，较难保证调查质量（C错）；④耗费的人力、物力资源一般较大，费用往往较高。